女，48岁。风湿性心脏瓣膜病10年。喘憋1天。查体BP120/70mmHg，端坐位，双肺可闻及湿性啰音，心率106次/分，律齐，心尖部可闻及舒张期杂音，双下肢无水肿。缓解该患者喘憋的首选药物为
A. 美托洛尔
B. 胺碘酮
C. 呋塞米
D. 普罗帕酮
E. 地高辛

正确答案：C。呋塞米

解析：患者中年女性，风湿性心脏瓣膜病史10年，心尖部可闻及舒张期杂音（二尖瓣狭窄典型杂音），喘憋1天，端坐位，双肺可闻及湿性啰音（急性左心衰竭的典型体征），考虑诊断为伴二尖瓣狭窄的急性左心衰竭。患者喘憋的原因应为急性左心衰竭导致的急性肺水肿。此时首选呋塞米（C对）快速利尿，减少体液潴留，同时扩张静脉，缓解肺水肿。美托洛尔（P172）（A错）为β受体阻滞剂，其禁忌症包括急性心力衰竭。胺碘酮（B错）、普罗帕酮（D错）为广谱抗心律失常药，该患者心律整齐，不必首选抗心律失常治疗。地高辛（E错）属于洋地黄类药物（P172），最适合用于伴有快速心房颤动/心房扑动的收缩性心力衰竭。